起于舌骨体和大角的连接处，有茎突舌骨韧带附着
A. 舌骨体上下
B. 舌骨大角
C. 舌骨小角
D. 舌肌
E. 舌外肌

正确答案：C。舌骨小角

解析：舌骨小角起于舌骨体和大角的连接处，有茎突舌骨韧带附着。掌握“蝶骨、颞骨及舌骨的解剖特点”知识点。